中毒型细菌性痢疾的临床表现错误的是
A. 突然出现高热
B. 未腹泻前即出现严重的感染中毒表现
C. 开始即发热、腹泻，2～3天内再发展为中毒型
D. 全身中毒症状严重
E. 也有开始出现米泔水样便

正确答案：E。也有开始出现米泔水样便

解析：中毒型细菌性痢疾是急性细菌性痢疾的危重型，其临床特征以起病急骤，突发高热、反复惊厥、嗜睡、昏迷和休克为特征。本病起病急骤，全身中毒症状严重（D对），高热可>40℃或更高（A对），未腹泻前即出现严重的感染中毒表现（B对），少数患儿体温不升，反复惊厥，迅速发生呼吸衰竭、休克或昏迷；也有在发热，脓血便2～3天后开始发展为中毒型（C对），临床可分为四型：休克型（皮肤内脏微循环障碍型）、脑型（脑循环障碍型）、肺型（肺微循环障碍）和混合型。米泔水样便（E错，为本题正确答案）属于霍乱的临床表现。